下列药品中，可以通过网络向个人消费者销售的是
A. 中药饮片川芎
B. 芬太尼注射液
C. A型肉毒毒素制剂
D. 含麻黄碱类复方制剂

正确答案：A。中药饮片川芎

解析：本题考查网络药品经营管理。疫苗、血液制品、麻醉药品、精神药品、医疗用毒性药品、放射性药品、药品类易制毒化学品等国家实行特殊管理的药品不得在网上销售（BC错）。国家药品监督管理部门于2013年10月29日印发《关于加强互联网药品销售管理的通知》（食药监药化监〔2013〕223号），明确规定含麻黄碱类复方制剂（D错）（含非处方药品种）一律不得通过互联网向个人消费者销售（A对）。